饮水氯消毒时，接触30分钟后，游离性余氯不得低于
A. 1.0mg/L
B. 0.5mg/L
C. 0.3mg/L
D. 0.05mg/L
E. 1.5mg/L

正确答案：C。0.3mg/L

解析：本题考查游离性余氯的量。饮用水氯消毒是一种常用的水处理方法，它可以有效地杀灭水中的细菌和病毒，从而保证饮用水的安全性。在氯消毒过程中，游离性余氯是检测水质安全性的重要指标，它可以反映水中残留的消毒剂的含量。因此，游离性余氯的含量必须符合饮用水卫生标准的规定，接触30分钟后，游离性余氯不得低于0.3mg/L（C对ABDE错），才能保证饮用水的安全性。